下列哪项是胃小弯溃疡合并出血的最佳手术方案
A. 胃大部切除术
B. 迷走神经干切断术
C. 选择性胃迷走神经切断术
D. 高选择性迷走神经切断术
E. 迷走神经干切断术加胃幽门成形术

正确答案：A。胃大部切除术

解析：胃溃疡合并出血由于其有恶变的可能（5%），发病率较高，所以手术的态度应该更积极些，主要采用胃大部切除术。胃迷走神经切断术适用于治疗单纯性溃疡病，其包括迷走神经干切断术（B错）、选择性胃迷走神经切断术（C错）、高选择性迷走神经切断术（D错）；迷走神经干切断术加胃幽门成形术适用于胃十二指肠溃疡大出血且难以承受胃大部切除术者（E错）。